一位心理学专家为了对一3岁幼儿作心理评估，去孩子所在的幼儿园观看该幼儿在游戏中的表现，这种心理评估的方法是
A. 现状调查法
B. 自由式会谈法
C. 实验研究法
D. 观察研究法
E. 心理测验法

正确答案：D。观察研究法

解析：观察研究是指一般在完全自然或不加控制的条件下，对人的可观察到的行为进行观测和记录。例如，可以通过单向玻璃来观察。该法的优点是简便、易行，可得到许多基本的、比较真实的资料；不足的是不适于准确评定人内心的认知情感，常带有主观性和偶然性。有时对某些行为的观察是不现实，或难以得到被观察者的同意。掌握“医学心理学研究方法及其应用”知识点。